某地健康人血清氯总体均数μ0＝102mmol/L，抽查25名呼吸性碱中毒病人血清氯＝112mmol/L，S＝15mmol/L，呼吸性碱中毒病人和健康人有无差别的假设检验可用
A. t检验
B. u检验
C. 方差分析
D. χ²检验
E. 方差齐性检验

正确答案：A。t检验